下列哪项是病例对照研究的优点
A. 估计危险因素的暴露情况时很少或没有偏倚
B. 在选择出暴露因素后可研究多种疾病结局
C. 可减少研究对象对回忆依赖性
D. 有可能确立该病的发病率
E. 可用于研究罕见病病因研究

正确答案：E。可用于研究罕见病病因研究

解析：本题考查病例对照研究的优点。病例对照研究特别适合于罕见病、潜伏期长疾病的病因研究（E对ABCD错），有时往往是罕见病病因研究的唯一选择。